与CO₂呼出量关系最密切的肺功能指标是
A. 肺通气量
B. 肺活量
C. 肺泡通气量
D. 最大通气量
E. 用力呼气量

正确答案：C。肺泡通气量

解析：A：肺通气量指单位时间内吸入或呼出的气体总量包括每分通气量和肺泡通气量。B：肺活量指尽力深吸气后再尽力呼气，所能呼出的最大气体量。C：肺泡通气量指每分钟吸入肺泡的新鲜空气量，即肺泡通气量＝（潮气量－无效腔气量）×呼吸频率。D：最大通气量指尽力做深快呼吸时，每分钟所能吸入或呼出的最大气体量。E：用力呼气量指尽力深吸气后，再尽力尽快呼出的最大气体量。可见A、B、D、E均包括由于解剖无效腔存在而不能进行气体交换的那部分气体，所以，真正有效的气体交换量应以肺泡通气量为准（C对），即与CO₂呼出量关系最密切。